妊娠中晚期妇女禁用的药品是
A. 维A酸
B. 美托洛尔
C. 烟酸
D. 碳酸钙
E. 青霉素

正确答案：B。美托洛尔

解析：本题考查妊娠期妇女用药注意事项。妊娠中晚期妇女禁用的药品是美托洛尔（B对）。美托洛尔、索他洛尔、普萘洛尔等β受体阻断剂可通过胎盘进入胎儿体内，有报道妊娠高血压者可导致宫内胎儿发育迟缓，分娩时无力造成难产，新生儿可产生低血压、低血糖、呼吸抑制及心率减慢，故在中晚期禁用。维A酸（A错）有很强的致畸作用，禁用于妊娠早期（头3个月）妇女。烟酸（C错）慎用于妊娠和哺乳期妇女。碳酸钙（D错）可作补钙剂，吸收率高，妊娠妇女可以应用。青霉素（E错）是一种高效、低毒的抗生素，妊娠妇女可以应用，而且是妊娠妇女最安全的退烧药。